男，60岁。双侧颈部淋巴结肿大2个月，发热半个月，最高体温38.2℃。经检查双侧颈部及腋窝多发肿大淋巴结，最大者直径4cm，其他部位淋巴结无异常，淋巴结病理检查诊断为血管免疫母细胞T细胞淋巴瘤。首选的治疗是
A. 靶向治疗
B. 局部放射治疗
C. 中药治疗
D. 免疫治疗
E. 化学治疗

正确答案：E。化学治疗

解析：血管免疫母细胞T细胞淋巴瘤（属于非霍奇金淋巴瘤NHL），NHL首选以化疗为主的化、放疗结合的综合治疗（E对）。